可作为醋酸氢化可的松溶液渗透压调节剂的是
A. 硫柳汞
B. 氯化钠
C. 聚山梨酯80
D. 羟甲基纤维素钠
E. 注射用水

正确答案：B。氯化钠

解析：本题考查用作滴眼剂渗透压调节剂的辅料。氯化钠（B对）可作为醋酸氢化可的松溶液渗透压调节剂；硫柳汞（A错）为常用抑菌剂；聚山梨酯80（C错）可作乳化剂；羟甲基纤维素钠（D错）可作助悬剂；注射用水（E错）作为溶剂。